属于闭式引流的是
A. 负压引流
B. 油纱条引流
C. 片状引流
D. 管状引流
E. 碘仿纱条引流

正确答案：A。负压引流

解析：负压引流创口是封闭的，故亦称闭式引流。掌握“口外手术打结、缝合及外科引流”知识点。